心力衰竭时出现能量利用障碍的最常见原因是
A. 心肌过度肥大
B. 心脏缺血缺氧
C. 维生素B1缺乏
D. 肌浆网Ca2+摄取能力减弱
E. 肌钙蛋白与Ca2+结合障碍

正确答案：A。心肌过度肥大

解析：心力衰竭发生机制之一心肌收缩功能降低可再细分为心肌收缩相关的蛋白改变、心肌能量代谢障碍、心肌兴奋-收缩耦联障碍。冠心病引起的心脏缺血缺氧（B错）、维生素B1缺乏（C错）引起的心肌细胞有氧氧化障碍均可导致心肌能量生成障碍（属于能量代谢障碍）。心肌过度肥大（A对）可使肌球蛋白头部的ATP酶活性降低，导致能量利用障碍（属于能量利用障碍）。肌浆网Ca2+摄取能力减弱（D错）、肌钙蛋白与Ca2+结合障碍（E错）均可导致心肌兴奋-收缩耦联障碍。